患者，女，27岁，已婚，停经46天，妊娠试验（+），恶心呕吐，食入即吐，神疲思睡，舌淡苔白，脉滑缓，诊为妊娠恶阻，其证候是
A. 痰滞
B. 胃虚
C. 肝热
D. 肝胃不和
E. 脾胃虚弱

正确答案：E。脾胃虚弱

解析：患者妊娠46天，并伴有恶心呕吐，食入即吐，神疲思睡，舌淡苔白，脉缓滑等脾虚之象。故属妊娠恶阻脾胃虚弱之证（E对）。痰滞证多表现为咳嗽痰多，痰质黏稠，胸脘痞闷，呕恶，纳呆，或头晕目眩，或形体肥胖，或神昏而喉中痰鸣等（A错）。胃虚证分胃气虚证、胃阳虚证、胃阴虚证，其中胃气虚证多表现为胃脘隐痛或痞胀、喜按，食少与气虚症状；胃阳虚证多表现为胃脘冷痛，喜温喜按，胃凉肢冷等；胃阴虚证多表现为胃脘嘈杂，饥不欲食，脘腹痞胀，灼痛等（B错）。肝热证多表现为头痛、烦躁、耳鸣、胁痛等与实热症状为主要表现的证候（C错）。肝胃不和以脘胁胀痛、嗳气、吞酸、情绪抑郁等为主要表现（D错）。